醋酸可的松滴眼剂（混悬液）的处方组成包括醋酸可的松（微晶）、聚山梨酯80、硝酸苯汞、硼酸、羧甲基纤维素、蒸馏水等。处方中作为抑菌剂的是
A. 羧甲基纤维素
B. 聚山梨酯80
C. 硝酸苯汞
D. 蒸馏水
E. 硼酸

正确答案：C。硝酸苯汞

解析：本题考查醋酸可的松滴眼剂中药用辅料的作用。在醋酸可的松滴眼剂（混悬液）处方中用作抑菌剂的是硝酸苯汞（C对）；羧甲基纤维素（A错）用作助悬剂；聚山梨酯80（B错）用作乳化剂；蒸馏水（D错）用作溶剂；硼酸（E错）用作渗透压调节剂。